患者，男，18岁。突然出现无痛性腹泻，米泔水样便，量多，大便频繁，继之出现喷射状呕吐，呕吐物为米泔水样。查体：神志淡漠，声音嘶哑，眼窝深凹，口唇干燥，应首先考虑的是
A. 霍乱
B. 急性细菌性痢疾
C. 急性胃肠炎
D. 伤寒
E. 副伤寒

正确答案：A。霍乱

解析：患者青年男性，突然出现无痛性腹泻，米泔水样便（霍乱特征性表现），量多，大便频繁，继之出现喷射状呕吐，呕吐物为米泔水样，故患者应首先考虑的诊断是霍乱（A对）。急性细菌性痢疾（P150）（B错）主要表现为腹泻、腹痛、排黏液脓血便及里急后重，而本患者无腹痛。急性胃肠炎（人卫八版内科学P364）（C错）主要表现为恶心、呕吐、腹痛、腹泻、发热，而本患者无腹痛及发热。伤寒（D错）（P150）主要表现为持续发热、表情淡漠、相对缓脉、玫瑰疹、肝脾大和白细胞减少等。、副伤寒（P157）（E错）表现为起病急、寒战、体温迅速上升，热型不规则。